肝的主要功能是分泌胆汁、参与代谢、贮存糖原、解毒及吞噬防御等，胚胎时期还有造血功能。肝呈楔形，分为上、下2面和前、后、左、右4缘。肝的上面隆凸，与膈相接，称膈面。膈面被镰状韧带分为大而厚的右叶和小而薄的左叶。肝下面凹凸不平，与腹腔脏器相邻，称脏面。脏面有一近似“H”形的沟，即２条矢状位的左、右纵沟和１条冠状位的横沟。与肝脏面无关的结构为
A. 肝固有动脉
B. 肝圆韧带
C. 下腔静脉
D. 胆囊
E. 镰状韧带

正确答案：E。镰状韧带

解析：肝脏面上有肝固有动脉(A错)，肝圆韧带(B错)，下腔静脉(C错)，胆囊(D错)，镰状韧带(E对)位于肝膈面。